下列有关概率与频率，说法正确的是
A. 概率常用符号M表示
B. 频率常用符号P表示
C. 概率是描述某随机事件发生可能性大小的指标
D. 概率就是频率
E. 概率的取值范围介于-1和+1之间

正确答案：C。概率是描述某随机事件发生可能性大小的指标

解析：概率是描述某随机事件发生可能性大小的指标（C对）。事件A发生的概率可以写成P（A），所以概率常用符号P表示（AB错）。概率不是频率，但概率可以用稳定的频率进行解释，即在大量的观察或试验中，事件A出现的相对频率（D错）。概率的取值范围介于0和1之间（E错）。